患者，女，30岁，持续发热2周，有先天性心脏病病史。入院查体：贫血貌，胸骨左缘3～4肋间4/6级粗糙收缩期杂音伴震颤，脾肋下2cm，血培养两次阳性。入院后3天突感呼吸困难、胸痛，咯血多次，可能性最大的诊断是
A. 感染性心内膜炎合并急性肺栓塞
B. 感染性心内膜炎合并肺部感染
C. 室间隔缺损合并支气管扩张症
D. 室间隔缺损合并急性心衰
E. 室间隔缺损合并肺部感染

正确答案：A。感染性心内膜炎合并急性肺栓塞

解析：本题考查室间隔缺损的临床表现。患者，女，30岁，持续发热2周，有先天性心脏病病史。入院查体：贫血貌，胸骨左缘3～4肋间4/6级粗糙收缩期杂音伴震颤（提示可能存在室间隔缺损），脾肋下2cm，血培养两次阳性。入院后3天突感呼吸困难、胸痛，咯血多次，可能性最大的诊断是感染性心内膜炎合并急性肺栓塞（A对）。感染性心内膜炎合并肺部感染（B错）除感染性心内膜炎的症状和体征外，还会有咳嗽、咳痰、咳痰等肺部感染征象。室间隔缺损易并发支气管炎，反复发生支气管炎症，致使支气管壁结构破坏，引起支气管异常和持久性扩张，导致支气管扩张症（C错），除室间隔缺损的症状和体征外，主要症状为持续或反复的咳嗽、咳痰或可脓痰，可有咯血，可出现杵状指；可依靠高分辨CT确诊。室间隔缺损易并发充血性心力衰竭，若合并急性心衰（D错），可表现为突发严重呼吸困难，强迫坐位、面色灰白、发绀、大汗、烦躁，同时频繁咳嗽，咳粉红色泡沫状痰，听诊两肺满布湿性啰音和哮鸣音。室间隔缺损合并肺部感染（E错），除室间隔缺损的症状和体征外，还会有咳嗽、咳痰、咳痰等肺部感染征象。